能说明慢性中毒危险性大小的指标是
A. 急性毒作用带
B. 慢性毒作用带
C. 安全系数
D. 以上都是
E. 以上都不是

正确答案：B。慢性毒作用带